桡神经损伤常有的临床表现是
A. 五指爪形手畸形
B. 伸腕屈指障碍
C. 伸腕伸指障碍
D. 前臂旋转活动受限
E. Froment征阳性

正确答案：C。伸腕伸指障碍

解析：桡神经损伤表现为伸腕、伸拇、伸指、前臂旋后障碍及手背桡侧（虎口区）感觉异常（C对），典型的畸形是垂腕。尺神经运动功能障碍为第3、4蚓状肌麻痹所致的环、小指爪形手畸形，骨间肌和拇收肌麻痹所致的Froment征（E错）。